药品监督管理部门在药品评价过程中，发现某药品对心血管副作用很大，决定停止销售和使用，A医生将之前购买的药品自用，B医生继续开具该药品的处方，药剂科继续调剂该药品，问以上行为不受《药品管理法》约束的是
A. 药品监督管理部门的行政决定
B. 生产企业的销售行为
C. 药剂科的调剂行为
D. A医生的自用行为
E. B医生的处方行为

正确答案：D。A医生的自用行为

解析：本题考查《药品管理法》的适用范围。以上行为不受《药品管理法》约束的是A医生的自用行为（D错。为本题正确答案）。《药品管理法》适用于在中华人民共和国境内从事药品的研制、生产、经营、使用和监督管理的单位或者个人。药品监督管理部门的行政决定（A对）属于药品的监督管理。生产企业的销售行为（B对）属于药品的生产、经营。药剂科的调剂行为（C对）和B医生的处方行为（E对）属于药品的使用。